28岁，孕34周。10天前开始感觉乏力，食欲差，近5天病情加重，伴呕吐，巩膜发黄，神志欠清而入院，血压135/90mmHg，ALT35U/L，胆红素176μmol/L，尿蛋白（-）。首先选择的检查是
A. 全血细跑计数
B. 碱性磷酸酶
C. 胆酸
D. 肝炎病毒抗原抗体七项
E. 血糖

正确答案：D。肝炎病毒抗原抗体七项

解析：孕妇乏力，食欲差，伴呕吐，巩膜发黄，ALT35U/L（正常值0～40U/L），胆红素176umol/L（正常值1.71～17.1umol/L），根据临床表现和实验室检查，最可能的诊断是妊娠合并重型肝炎，由于乙型肝炎最为常见，因此首选的检查应是肝炎病毒抗原抗体七项（乙肝表面抗原HbsAg、乙肝表面抗体HbsAb、乙肝e抗原HbeAg、乙肝e抗体HbeAb、乙肝核心抗原HbcAb、前S1抗原、前S2抗原）（D对）。全血细跑计数（A错）、碱性磷酸酶（B错）、胆酸（C错）、血糖（E错）的诊断意义不大。